健康儿，能大笑，开始能发出“爸爸”、“妈妈”之复音，脊柱出现第二个生理弯曲，对“再见”还不懂，其年龄可能是
A. 3～4个月
B. 5～6个月
C. 7～8个月
D. 9～10个月
E. 11～12个月

正确答案：C。7～8个月

解析：新生儿已会哭叫，2个月发喉音，3～4个月咿呀发音，5～6个月会发单音，7～8个月能无意识发出复音，如“爸爸”、“妈妈”，9个月能听懂“再见”等。掌握“运动和语言发育”知识点。